流行性出血热低血压休克期的治疗不包括
A. 扩充血容量
B. 纠正酸中毒
C. 静脉滴注血管活性药
D. 静脉滴注强心剂
E. 利尿

正确答案：E。利尿

解析：流行性出血热少尿期的治疗：稳定内环境、促进利尿（E错，为本题正确答案）、导泻疗法、透析疗法、中医辨证疗法。低血压休克期的治疗包括：扩充血容量（A对）、纠正酸中毒（B对）、静脉滴注血管活性药（C对）、静脉滴注强心剂（D对）与糖皮质激素的应用。